市场流通国产药品监督管理的首要依据是
A. 企业药品标准
B. 进口药品注册标准
C. 国际药典
D. 国家药品标准
E. 药品注册标准

正确答案：D。国家药品标准

解析：本题考查国家药品标准。市场流通国产药品监督管理的首要依据是国家药品标准（D对）。国家药品标准是我国法定的药品标准，具有法律效力。它是国家为保证药品质量所制定的关于药品的规格、检验方法以及生产工艺的技术要求，也是药品的生产、经营、使用、检验和监督管理部门共同遵循的法定依据。药品出厂放行的标准依据是企业药品标准（A错）。《中华人民共和国药品管理法》规定：药品生产企业应当对药品进行质量检验。不符合国家药品标准的，不得出厂。药品生产企业应当建立药品出厂放行规程，明确除应当按照国家药品标准或药品注册标准的规格与要求生产药品外，同时还应当制定有该药品的出厂放行规程。出厂放行规程亦称为“企业药品标准”或“企业内控标准”，仅在本企业的药品生产质量管理中发挥作用，属于非法定标准。《国际药典》（C错）是由世界卫生组织编撰，旨在为所选药品、辅料和剂型的质量标准达成一个全球范围的统一的标准性文献。药品注册标准（E错）是指由国务院药品监督管理部门（国家药品监督管理局，NMPA）核准给申请人特定药品的质量标准（也称为“核准标准”），生产该药品的药品生产企业应当执行该注册标准。药品注册标准不得低于国家药品标准的相关规定。